CPSⅠ和CPSⅡ均催化氨基甲酰磷酸的合成，而生成的氨基甲酰磷酸可参与尿素和嘧啶核苷酸合成，下述有关其叙述中哪项正确
A. CPSⅠ参与嘧啶核苷酸合成
B. CPSⅡ参与尿素的合成
C. N乙酰谷氨酸是CPSⅠ的别构激活剂
D. N乙酰谷氨酸是CPSⅡ的别构抑制剂
E. CPSⅠ可作为细胞增殖的指标，CPSⅡ可作为肝细胞分化指标

正确答案：C。N乙酰谷氨酸是CPSⅠ的别构激活剂